肠易激综合症患者几乎都有的临床症状是
A. 腹泻
B. 肠瘘
C. 腹痛
D. 便秘
E. 腹胀

正确答案：C。腹痛

解析：几乎所有肠易激综合征患者都有腹痛（C对）或腹部不适，也可有排便习惯和粪便性状改变，表现为腹泻（A错）或便秘（D错），常伴腹胀（E错）、排便不尽感。肠瘘（B错）是肠道的器质性病变，多见于克罗恩病（P377），而肠易激综合征是功能性肠病，不会出现肠瘘。